心脏前负荷过重的常见原因是
A. 肺动脉高压
B. 肺栓塞
C. 慢性贫血
D. 主动脉狭窄
E. 心肌炎

正确答案：C。慢性贫血

解析：心室负荷过重包括前负荷（收缩前承受的负荷）、后负荷（射血时克服的阻力）过重。慢性贫血（C对）时，外周血管阻力降低，静脉回心血量增加，导致心脏前负荷过重。肺动脉高压（A错）、肺栓塞（B错）、主动脉狭窄（D错）时，肺循环或体循环阻力增加，导致心脏后负荷过重。心肌炎（E错）时，心肌细胞变性坏死，导致心肌收缩性降低。